男，重体力劳动工人。腰腿痛，向左下肢放射，咳嗽、喷嚏时加重1月。检查：腰部活动明显受限，并向左倾斜，直腿抬高试验阳性。病程中无低热盗汗消痩症状。首先考虑的诊断是
A. 腰肌劳损
B. 腰椎管狹窄症
C. 腰椎间盘突出症
D. 强直性脊柱炎
E. 腰椎结核

正确答案：C。腰椎间盘突出症

解析：患者男性、重体力劳动工人，腰腿痛、向左下肢放射、咳嗽喷嚏时加重（腰椎间盘突出症典型表现），腰部活动明显受限、向左倾斜，直腿抬高试验阳性（腰椎间盘突出症的重要体征），结合患者症状和体征，该患者首先考虑的诊断是腰椎间盘突出症（C对）。腰肌劳损（P734）（A错）为腰部肌肉极其附着点筋膜或骨膜的慢性损伤性炎症，主要表现为无明显诱因的慢性疼痛，休息后可缓解，无咳嗽时腰腿痛加重的表现。腰椎管狭窄症（P734）（B错）多以下腰痛、马尾神经或腰神经受压症状为主要表现，以神经源性间歇性跛行为主要特点。强直性脊柱炎（P765）（D错）主要累及骶髂关节，主要表现为下腰痛，晨僵，活动后缓解。腰椎结核（E错）多有低热、盗汗、消瘦等结核中毒症状。